以下哪一项属于慢性牙周炎时患者牙龈的表现
A. 牙龈红肿
B. 龈缘菲薄紧贴牙面
C. 牙龈质地坚韧
D. 龈沟深度2mm以内
E. 牙龈探诊后牙龈无出血

正确答案：A。牙龈红肿

解析：牙龈的炎症表现为鲜红或暗红色，在牙石堆积处有不同程度的炎性肿胀甚至增生，探诊易出血，甚至流脓。掌握“慢性牙周炎的病因，表现诊断及预后”知识点。